诊断有机磷中毒的最重要指标为
A. 确切的接触史
B. 毒蕈碱样和烟碱样症状
C. 全血胆碱酯酶活力降低
D. 阿托品试验阳性
E. 呕吐物有大蒜味

正确答案：C。全血胆碱酯酶活力降低